郁金具有的功效是
A. 活血行气，祛风止痛
B. 活血行气，清心凉血
C. 活血调经，除烦安神
D. 活血通经，清热解毒
E. 活血通经，祛瘀止痛

正确答案：B。活血行气，清心凉血

解析：该题考查郁金的功效。郁金味辛、苦，性寒，入肝、胆、心经，其功效为血止痛，行气解郁，清心凉血，利胆退黄（B对）。